男，75岁。排尿困难3年，加重2周。直肠指检发现前列腺结节，质地硬。血清PSA30ng/ml。下列检查对患者病情评价意义不大的是
A. 前列腺MRI
B. 泌尿系B超
C. 放射性核素骨显像
D. X线胸片
E. 膀胱尿道造影

正确答案：E。膀胱尿道造影

解析：CT对早期前列腺癌的诊断价值不大。MRI（A对）对前列腺的诊断优于其他影像学方法。有骨转移时X线平片（D对）可显示成骨性骨质破坏。骨转移可用放射性核素骨显像（C对）。前列腺癌的确诊依靠经直肠超声引导下（B对）前列腺系统性穿刺活检，根据所获组织有无癌作出诊断。因此，膀胱尿道造影检查（E错）对患者病情评价意义不大。